女，40岁。腹泻1年。体检发现一肛瘘，结肠镜示回盲部铺路石样改变，最可能的诊断是
A. 结肠癌
B. 溃疡性结肠炎
C. 细菌性痢疾
D. 克罗恩病
E. 肠结核

正确答案：D。克罗恩病

解析：中年女性患者，腹泻（克罗恩病的常见症状）1年。体检发现一肛瘘（瘘管形成是克罗恩病的特征性临床表现）。结肠镜示回盲部铺路石样改变（鹅卵石征，克罗恩病的特征性病理改变）。综合该患者的病史、体检及结肠镜检查，考虑诊断为克罗恩病（D对）。结肠癌（P382）（A错）多见于老年患者，有黏液脓血便伴里急后重，结肠镜检可见肠腔狭窄、黏膜皱襞破坏或结节性肿块。溃疡性结肠炎（P374）（B错）临床以反复发作的腹泻、黏液脓血便、左下腹或下腹阵痛为特征，少有瘘管形成，结肠镜可见黏膜充血水肿，弥漫性糜烂和多发性浅溃疡形成。细菌性痢疾（C错）有黏液脓血便伴里急后重，结肠镜下呈地图状溃疡。肠结核（P368）（E错）多有低热、盗汗、消瘦等结核毒血症状，结肠镜可发现回盲部黏膜充血、水肿、溃疡形成。